“入芝兰之室，久闻而不知其香”说明的是
A. 感觉相互作用
B. 感觉适应
C. 感觉过敏
D. 感觉减退
E. 感觉补偿

正确答案：B。感觉适应

解析：“入芝兰之室，久闻而不知其香”意思是走进摆满香草的地方，时间久了就闻不到香草的香味了，即由于香草（刺激物）对鼻子（感受器）的持续作用使感受性发生提高的现象，即为感觉的适应（B对），感觉相互作用是指当一种感觉器官受到刺激而产生一种特定感觉的同时又产生另外一不同的感觉。如颜色的感觉就具有冷暖感，远近感”（A错）
感觉过敏是指感受阈限低感受性高（C错），感觉减退是指阈限高而感受性低（D错）。感觉补偿是指当某种感受器受到损伤之后，在社会生活与实践活动的影响下，其他感受器的感受性大大提高的现象（E错）。